只能肌内注射给药的是
A. 低分子溶液型注射剂
B. 高分子溶液型注射剂
C. 乳剂型注射剂
D. 混悬型注射剂
E. 注射用冻干粉针剂

正确答案：D。混悬型注射剂